有关筛检，以下哪一说法不正确：
A. 为了发现罕见的疾病
B. 所筛检的疾病是危害人群健康的严重疾病
C. 一旦筛检发现可疑病例后，有确实的诊断手段和治疗措施
D. 对所筛检的疾病有比较全面的认识
E. 筛检的方法不应给群众精神与身体的伤害

正确答案：A。为了发现罕见的疾病

解析：本题考查筛检的相关内容。筛检的目的是发现隐匿的病例（A错，为本题正确答案）；发现高危人群；了解疾病的自然史，解释疾病的“冰山现象”；指导合理分配有限的卫生资源。筛检者对所筛检的疾病应有比较全面的认识（D对），所筛检疾病或相关健康状态应是该地区现阶段的重大公共卫生问题，能对人群健康和生命造成严重危害，现患率或死亡率较高，是人群的主要死因之一（B对）。对筛查出的不同阶段结局均有行之有效的干预方案（C对），且确保早期治疗的效果应优于晚期治疗。筛检的方法不应给群众精神与身体的伤害（E对）。